男婴，早产，生后10天。母乳喂养，为预防佝偻病，家长来医院咨询。医师给予家庭护理的指导不恰当的是
A. 坚持母乳喂养
B. 坚持日光浴
C. 生后2周添加鱼肝油
D. 合理补充钙剂
E. 2个月开始添加蛋黄

正确答案：E。2个月开始添加蛋黄

解析：本题考查预防佝偻病的家庭护理。该早产男婴，不建议2个月开始添加蛋黄（E错，为本题正确答案），对于新生儿尤其是早产儿，这个阶段的消化系统发育还不是很完善，是不可以添加辅食，一般这个阶段的宝宝除了母乳喂养以外，主要是采取奶粉喂养，添加辅食至少需要等宝宝六个月以后才可以添加，以免过早的添加辅食，宝宝容易引起消化不良，导致腹泻，影响生长发育。预防佝偻病的家庭护理可坚持母乳喂养（A对）、坚持日光浴（B对）、生后2周添加鱼肝油（C对）、合理补充钙剂（D对）。